男，20岁。四肢无力4天，呼吸困难1天。无大小便障碍，无发热。查体：四肢肌力1级，腱反射消失，病理反射未引出。首先考虑的疾病是
A. 脊髓灰质炎
B. 吉兰一巴雷综合征
C. 周期性瘫痪
D. 重症肌无力
E. 急性脊髓炎

正确答案：B。吉兰一巴雷综合征

解析：青年男性患者，四肢无力4天、呼吸困难1天（吉兰一巴雷综合征患者急性起病），四肢肌力1级，腱反射消失，病理反射未引出（吉兰一巴雷综合征患者表现为对称性肢体肌肉无力，四肢腱反射减弱或消失），综合患者的病史、体征，首先应考虑的疾病是吉兰一巴雷综合征（B对）。脊髓灰质炎（P351）（A错）患者起病时多有发热、肢体瘫痪常局限于一侧下肢，无感觉障碍。周期性瘫痪（P371）（C错）患者表现为突发四肢迟缓性瘫痪，无脑神经支配肌肉损害，无意识障碍和感觉障碍。重症肌无力（P351）（D错）表现为受累骨骼肌病态疲劳、症状波动、晨轻暮重。急性脊髓炎（P322）（E错）患者急性起病，病前有感染史或预防接种史，可出现受累平面以下运动障碍、感觉缺失及膀胱、直肠括约肌功能障碍。